初产妇，26岁。宫口开全1小时40分，先露+1，枕右后位，宫缩由强转弱50分钟，宫缩间隔由2分钟延长为6～8分钟。本例最可能的原因是
A. 骨盆出口狭窄
B. 骨盆入口狭窄
C. 产妇乏力、肠胀气
D. 原发性子宫收缩乏力
E. 中骨盆狭窄

正确答案：E。中骨盆狭窄

解析：青年初产妇，宫口开全1小时40分（第二产程是指宫口开全至胎儿娩出的过程），先露+1，枕右后位（内旋转受阻，持续性枕后位），宫缩强度由强转弱50分钟（宫缩乏力，发生于第二产程，为继发性），宫缩间隔由2分钟延长为6～8分钟（协调性宫缩乏力表现），根据该孕妇产程表现，诊断考虑为继发性宫缩乏力，最可能的原因是中骨盆狭窄（E对），中骨盆狭窄时，由于内旋转受阻，胎头双顶径被阻于中骨盆狭窄部位之上，常出现持续性枕横位或枕后位，同时出现继发性宫缩乏力，活跃期晚期及第二产程延长甚至第二产程停滞。原发性宫缩乏力（D错）是指产程开始就出现宫缩乏力，宫口不能如期扩张，胎先露部不能如期下降，导致产程延长；继发性宫缩乏力是指产程开始子宫收缩正常，只是在产程较晚阶段（多在活跃期后期或第二产程），子宫收缩转弱，产程进展缓慢甚至停滞（P188）。产妇乏力肠胀气（C错）是宫缩乏力导致的结果，而非原因。骨盆入口狭窄（B错）时一般胎头衔接受阻，即使已经临产，胎头仍不能入盆，而该孕妇已先露+1。该孕妇先露+1，考虑为中骨盆受阻，骨盆出口狭窄（A错）不能确定。